《中国药典》一部的附录规定，要检测残留量的农药有
A. 有机氯类农药
B. 有机磷类农药
C. 有机硫类农药
D. 氨基甲酸酯类农药
E. 拟除虫菊酯类农药

正确答案：A、B、E。有机氯类农药；有机磷类农药；拟除虫菊酯类农药

解析：本题考查的是农药残留量。《中国药典》一部的附录规定，要检测残留量的农药有有机氯类农药（A对）、有机磷类农药（B对）、拟除虫菊酯类农药（E对）。《中国药典》采用气相色谱法测定中药中部分有机氯类农药残留量、有机磷类农药残留量和拟除虫菊酯类农药残留量，质谱法测定农药多残留量。